集中式供水的卫生监督的内容不包括
A. 水源选择是否符合卫生要求
B. 供水系统是否能处理足够的水量
C. 由于已多次清洗设备，不必检验水质
D. 处理后的水质能否达到水质卫生标准要求
E. 施工过程和验收时应审核是否符合原设计

正确答案：C。由于已多次清洗设备，不必检验水质

解析：本题考查集中式供水的卫生监督的内容。集中式供水的卫生监督一般是指对集中式供水系统和供水设备进行监督管理，以确保供水水质符合卫生要求。集中式供水的卫生监督内容包括：水源选择是否符合卫生要求（A对）；供水系统是否能处理足够的水量（B对）；处理后的水质能否达到水质卫生标准要求（D对）；施工过程和验收时应审核是否符合原设计（E对）等。由于已多次清洗设备，不必检验水质（C错，为本题正确答案）不是集中式供水的卫生监督的内容。